某育妇女停经45天，经诊断停经且其意愿为终止妊娠，医生开具的与前列腺素类药物序贯使用的药物是
A. 左炔诺孕酮片
B. 复方庚酸炔诺酮注射液
C. 去氧孕烯炔雌醇片
D. 米非司酮片
E. 双炔失碳酯肠溶片

正确答案：D。米非司酮片

解析：本题考查避孕药。米非司酮片（D对）与前列腺素药物序贯合并使用，可用于终止停经49日内的妊娠。左炔诺孕酮（A错）单方制剂用作紧急避孕药。复方己酸羟孕酮注射液、复方庚酸炔诺酮注射液（B错）均为每月一次的避孕药。去氧孕烯炔雌醇片（C错）用于避孕和月经周期调控。双炔失碳酯肠溶片（E错）为探亲避孕药，每次房事后立即服1片，但第一次房事后次日晨须加服1片；以后每日最多1片，每月不少于12片。